下列叙述中不符合我国中药管理规定的是
A. 新发现的药材，必须经国务院药物监督管理部门审核批准方可销售
B. 药品经营企业购进中药材应标明产地
C. 城乡集市贸易市场可以销售中药材、中药饮片、中成药
D. 实施批准文号管理的中药材，必须从具有药品生产、经营资格的企业购进
E. 中药材和中药饮片应有包装，并附有质量合格的标志

正确答案：C。城乡集市贸易市场可以销售中药材、中药饮片、中成药

解析：本题考查的是中药材专业市场管理。城乡集市贸易市场可以出售中药材，国务院另有规定的除外（C错，为本题正确答案）。《药品管理法》及其实施条例规定，城乡集市贸易市场可以出售中药材，国务院另有规定的除外。中药饮片生产管理：中药饮片既可根据中药处方直接调配煎汤（剂）服用，又可作为中成药生产的原料供制药厂使用，其质量好坏，直接影响中医临床疗效，直接关系到公众用药安全和中药现代化的进程。《药品管理法》规定：“中药饮片的炮制，必须按照国家药品标准炮制，国家药品标准没有规定的，必须按照省、自治区、直辖市药品监督管理部门制定的炮制规范炮制。”“生产新药或者已有国家标准的药品，须经国家药品监督管理部门批准，并发给批准文号（A对）；但是，生产没有实施批准文号管理的中药材和中药饮片除外。”“实行批准文号管理的中药材、中药饮片品种目录由国务院药品监督管理部门会同国务院中医药管理部门制定。”《药品管理法实施条例》规定：“生产中药饮片，应当选用与药品性质相适应的包装材料和容器；包装不符合规定的中药饮片，不得销售。”《中医药法》规定：“国家保护中药饮片传统炮制技术和工艺，支持应用传统工艺炮制中药饮片，鼓励运用现代科学技术开展中药饮片炮制技术研究。”中药饮片包装必须印有或贴有标签。中药饮片的标签必须注明品名、规格、产地（B对）、生产企业、产品批号、生产日期、实施批准文号管理的中药饮片还必须注明批准文号。针对中药饮片存在无包装或包装不符合法定规定的情况，《关于加强中药饮片包装监督管理的通知》（国食药监办〔2003〕358号）指出：严禁选用与药品性质不相适应和对药品质量可能产生影响的包装材料。中药饮片在发运过程中必须要有包装。每件包装上必须注明品名、产地、日期、调出单位等，并附有质量合格的标志（E对）。对不符合上述要求的中药饮片，一律不准销售。生产中药饮片必须持有《药品生产许可证》，应当遵守药品生产质量管理规范；必须以中药材为起始原料，使用符合药用标准的中药材（购进未实施审批管理的中药材除外），并应尽量固定药材产地；必须严格执行国家药品标准和地方中药饮片炮制规范、工艺规程；必须在符合药品GMP条件下组织生产，出厂的中药饮片应检验合格，并随货附纸质或电子版的检验报告书。中药饮片应当按照国家药品标准炮制；国家药品标准没有规定的，应当按照省、自治区、直辖市人民政府药品监督管理部门制定的炮制规范炮制。省、自治区、直辖市人民政府药品监督管理部门制定的炮制规范应当报国务院药品监督管理部门备案。不符合国家药品标准或者不按照省、自治区、直辖市人民政府药品监督管理部门制定的炮制规范炮制的，不得出厂、销售。中药饮片生产企业履行药品上市许可持有人的相关义务，对中药饮片生产、销售实行全过程管理，建立中药饮片追溯体系，保证中药饮片安全、有效、可追溯。批发零售中药饮片应当从药品上市许可持有人或者具有药品生产、经营资格的企业购进药品（D对）；但是，购进未实施审批管理的中药材除外。